血管神经性水肿发病诱因，与下列哪项无关
A. 外伤
B. 物理因素
C. 遗传性
D. 感染
E. 某些食物及药物

正确答案：A。外伤

解析：多数获得性血管神经性水肿患者不能找到确切原因。常见病因有以下方面：食物、药物、感染、物理因素、动物及植物因素、遗传性血管神经性水肿。掌握“血管神经性水肿”知识点。